内伤腰痛发病的关键是
A. 寒湿
B. 湿热
C. 肾虚
D. 气滞
E. 血瘀

正确答案：C。肾虚

解析：腰痛主要包括外感腰痛和内伤腰痛，其中内伤腰痛多属肾虚（C对）。外感腰痛则以感受风寒湿邪（A错）或湿热（B错）之邪为主；气滞（D错）血瘀（E错）之腰痛多由跌仆外伤或暴力等所致。